女性，65岁。冠心病心绞痛史8年，无高血压史，夜间突发心前区疼痛8小时入院，入院时血压为150/90mmHg（20/12kPa），经心电图检查，诊断急性前壁心肌梗死。最可能的心电图表现为
A. Ⅱ、Ⅲ、aVF出现异常Q波，伴ST段弓背向上抬高
B. V₁～V₄出现异常Q波伴ST段弓背向上抬高
C. V₁～V₄出现冠状T波
D. 频发室性早搏
E. Ⅲ度房室传导阻滞

正确答案：B。V₁～V₄出现异常Q波伴ST段弓背向上抬高

解析：患者老年女性，夜间突发心前区疼痛，急性前壁心肌梗死诊断明确，根据P246表3-4-4可知，最可能的心电图表现为V₁～V₄出现异常Q波，伴ST段弓背向上抬高（B对）。冠状T波是指正常直立的T波呈现双肢对称性倒置，可见于急性前壁心肌梗死恢复期，也可见于不稳定心绞痛发作后、肺栓塞和脑血管病等，缺乏特异性，故V₁～V₄出现冠状T波（C错）并非最佳答案。Ⅱ、Ⅲ、aVF出现异常Q波，伴ST段弓背向上抬高（A错）提示急性下壁心肌梗死，Ⅲ度房室传导阻滞（E错）也为下壁心肌梗死常见并发症状。频发室性早搏（D错）是指一分钟内有六次以上的室性早博，多在器质性心脏病基础上出现，可见于高血压、冠心病、心肌病、风湿性心脏病与二尖瓣脱垂病人，不具有特异性。